患者心烦易怒，眩晕，心悸，少寐，伴遗精腰痠，舌质红，脉弦细而数。治应首选
A. 六味地黄丸
B. 滋水清肝饮
C. 右归饮
D. 左归饮
E. 安神定志丸

正确答案：B。滋水清肝饮

解析：患者出现心烦易怒，眩晕，心悸，少寐，同时伴有遗精腰痠，故可诊断为郁证之阴虚火旺。脏阴不足， 营血暗耗，阴亏则虚阳上浮，故见眩晕易怒。阴血亏耗， 心神失养以及阴虚生热，虚热扰神，则心悸少寐而烦躁而烦躁。肾阴不足，腰府失养则跟腰酸。阴虚火旺，扰动精室，精关不固则遗精。治疗此种病证当以滋阴清热，镇心安神为治法以达到解郁的目的，方用滋水清肝饮。（B对）。六味地黄丸功用为滋补肝肾，主治肝肾阴虚证，症见腰膝酸软，头晕目眩，耳鸣耳聋，盗汗，遗精，消渴，骨蒸潮热，手足心热，口燥咽干，牙齿动摇，足跟作痛，小便淋沥，以及小儿自门不合，舌红少苔，脉沉细数，但无疏肝清肝之效（A错）。右归丸功用：温补肾阳，填精益髓。主治：肾阳不足，命门火衰证（C错）。左归丸功用：滋阴补肾，填精益髓。主治：真阴不足证。头晕目眩，腰酸腿软，遗精滑泄，自汗盗汗，口燥舌干，舌红少苔，脉细，也无疏肝清肝之效（D错）。安神定志丸主要适用于治疗心悸、怔忡、失眠、烦躁、惊狂等病证（E错）。